下列哪种菌体表面物质对牙周组织毒性最强
A. 脂磷壁酸
B. 外膜蛋白
C. 内毒素
D. 纤毛蛋白
E. 膜泡

正确答案：C。内毒素

解析：本题考查细菌表面物质的分子结构与致病性的关系。内毒素（C对）对牙周组织毒性最强。内毒素对牙周组织具有很高的毒性和抗原性，在牙周病的发生发展过程中起重要作用。脂磷壁酸（LTA）与内毒素一样具有刺激牙槽骨吸收的作用，有细胞毒作用（A错）。外膜蛋白（OMP）结构对细菌在宿主体内的生存能力、毒力传递和毒力变化都由明显影响（B错）。细菌对牙周组织的黏附是致病的第一步，细菌或纤毛在黏附过程中起着重要作用（D错）。膜泡（ECV）	在形成过程中包容并浓缩了许多细菌固有成分和毒性产物，膜泡游离后扩大了细菌毒力的作用范围和强度（E错）。